致病因子的流行病学研究有两类方法，即观察法与实验法，二者主要区别在于实验法中
A. 研究中设立对照
B. 研究组与对照组样本相同
C. 研究是前瞻性的
D. 研究组与对照组同时存在
E. 实验过程中人为给予的干预

正确答案：E。实验过程中人为给予的干预

解析：本题考查实验流行病学的特点。实验流行病学不同于描述性和分析性流行病学，后者在研究实施中只是描述或分析人群中的某些现象，从中找出规律性的结论，属于观察法。实验流行病学属于实验法，即有人为给予的干预（E对ABCD错）措施，并强调随机分配。